医师治疗热入心包、热动肝风证时，常投紫雪散。此因该中成药除清热开窍外，还能
A. 平肝安神
B. 止痉安神
C. 潜阳安神
D. 通络安神
E. 养心安神

正确答案：B。止痉安神

解析：本题考查的是紫雪散的功能。紫雪散除清热开窍外，还能止痉安神（B对）。紫雪散：【功能】清热开窍，止痉安神。脑立清丸：【功能】平肝潜阳，醒脑安神（AC错）。参松养心胶囊：【功能】益气养阴，活血通络，清心安神（D错）。酸枣仁：【功效】养心安神（E错），敛汗。